患者，男。餐后痛症状3年，现空腹突发上腹剧痛，放射至背部。最佳治疗方法是
A. 全身支持
B. 胃大部切除术
C. 内科药物
D. 球囊压迫
E. 支架填补

正确答案：B。胃大部切除术

解析：男性患者，餐后痛症状3年，提示患者有胃十二指肠溃疡（胃十二指肠溃疡患者病史可达数年或十余年；主要症状为上腹部疼痛或不适，疼痛呈周期性，节律性发作，如饥饿痛或餐后痛）。现患者空腹突发上腹剧痛，放射至背部，提示患者出现急性腹膜炎（最常见的腹膜炎为继发性化脓性腹膜炎，如胃十二指肠溃疡急性穿孔，胃内容物流入腹腔产生化学性刺激，诱发化脓性腹膜炎，继发感染后成为化脓性腹膜炎）。综合患者的病史、临床症状，初步诊断为胃十二指肠溃疡穿孔， 应行选择彻底的手术即胃大部切除术（B对），它可以一次性解决穿孔和溃疡两个问题。全身支持（A错）为患者的一般治疗措施，以促进患者机体恢复，但不是患者十二指肠溃疡穿孔的最佳治疗方法。内科药物（C错）可治愈胃十二指肠溃疡，但胃十二指肠溃疡穿孔为胃十二指肠溃疡并发症，需要外科手术治疗，故药物治疗并非该患者的最佳治疗方法。球囊压迫（D错）适用于胃十二指肠溃疡大出血。支架填补（E错）适用于恶性肿瘤浸润压迫引起胃、十二指肠管腔狭窄闭塞而造成的进食障碍，也可用于胃十二指肠良性疾病，如胃十二指肠溃疡瘢痕性幽门梗阻。